吗啡的适应证为
A. 颅脑外伤疼痛
B. 诊断未明急腹症疼痛
C. 哺乳期妇女镇痛
D. 分娩镇痛
E. 急性严重创伤、烧伤所致疼痛

正确答案：E。急性严重创伤、烧伤所致疼痛